某男，35岁。春节期间突患急性胆囊炎，症见胁痛，口苦，舌红苔黄。证属肝胆湿热，医师依据其要求，给其处以方便服用的消炎利胆颗粒。服用一周后，胁痛减轻，口苦不减。前日天气突然升温。又引起急性支气管炎，症见发热，恶寒，胸膈满闷，咳嗽咽痛。证属风热咳嗽。据此医师除给其处方以消炎利胆颗粒外，又增加了急支糖浆。并嘱其服用方法。此因急支糖浆除能凊热化痰外，又能
A. 宣肺止咳
B. 燥湿止咳
C. 理气止咳
D. 润肺止咳
E. 敛肺止咳

正确答案：A。宣肺止咳

解析：本题考查的是急支糖浆的功能。急支糖浆除能凊热化痰外，又能宣肺止咳（A对）。急支糖浆：【功能】清热化痰，宣肺止咳。川贝母：【功效】清热化痰，润肺止咳（D错），散结消痈。强力枇杷露：【功能】清热化痰，敛肺止咳（E错）。功能为燥湿止咳（B错）或理气止咳（C错）的中成药，2022年考试指南未明确说明。